适用于轻、中度高血压，伴有浮肿者更适宜的药物是
A. 可乐定
B. 吲达帕胺
C. 依那普利
D. 甲基多巴
E. 米诺地尔

正确答案：B。吲达帕胺

解析：本题考查吲达帕胺。适用于轻、中度高血压，伴有浮肿者更适宜的药物是吲达帕胺（B对）。吲达帕胺在临床上主要用于Ⅰ、Ⅱ期高血压以及多种原因所致的轻、中度水肿。可乐定（A错）和甲基多巴（D错）为中枢性降压药，用于治疗中度高血压。依那普利（C错）为血管紧张素Ⅰ转化酶抑制药，临床用于各期原发性高血压、肾性高血压、恶性高血压及充血性心力衰竭。米诺地尔（E错）为钾通道开放药，临床用于严重的原发性高血压或肾性高血压。